以下哪项不属于“5E”伤害预防综合策略
A. 教育预防策略
B. 环境改善策略
C. 减少危险因素含量策略
D. 工程策略
E. 强化执法策略

正确答案：C。减少危险因素含量策略

解析：本题考查“5E”伤害预防综合策略。“5E”伤害预防综合策略包括：1.教育预防策略 （education strategy）（A对）；2.环境改善策略（environmental modification strategy）（B对）；3.工程策略（engineering strategy）（D对）；4.强化执法策略 （enforcement strategy）（E对） ；5.评估策略 （evaluation strategy）。减少危险因素含量策略（C错，为本题正确答案）不属于“5E”伤害预防综合策略。